下列各项，不属预防性消毒的是
A. 日常卫生消毒
B. 饮用水消毒
C. 传染病学室的卫生清洁
D. 垃圾无害化处理
E. 饭前便后的洗手

正确答案：C。传染病学室的卫生清洁

解析：预防性消毒 指在未发现传染源存在的情况下、对可能被病原体污染的物品、场所和人体进行消毒措施。如公共场所消毒，运输工具消毒，饮水及餐具消毒（B对），医护人员手的消毒及手术室消毒（C错，为本题正确答案）。